不属于肱骨髁上骨折的临床表现的是
A. 肘部疼痛肿胀
B. 肘部皮下淤斑
C. 肘部三角异常
D. 手部皮肤苍白
E. 皮肤较冷

正确答案：C。肘部三角异常

解析：肘关节屈曲呈直角时，肱骨内外上髁和尺骨鹰嘴3点构成等腰三角形，称肘后三角。肱骨髁上骨折骨折部位在髁上，不影响肘部三角关系的形成，故肘后三角正常（C错，为本题正确答案）。肘部疼痛肿胀（A对）、肘部皮下淤斑（B对）、手部皮肤苍白、皮温较低（D对）、前臂缺血性肌坏死（E对）均可在肱骨髁上骨折时出现。